一年级200人，12岁患龋率20%，龋均1。二年级200人，13岁患龋率22.5%，龋均1.5。三年级100人，14岁患龋率25%，龋均2。龋均流行程度
A. 很高
B. 高
C. 中
D. 低
E. 很低

正确答案：E。很低

解析：本题考查龋病流行程度评价标准。一年级200人，12岁患龋率20%，龋均1。二年级200人，13岁患龋率22.5%，龋均1.5。三年级100人，14岁患龋率25%，龋均2。龋均流行程度为很低（E对）。WHO规定龋病的患病水平，以12岁龋均作为衡量标准。WHO 龋病流行程度的评价指标（12岁）：龋均(DMFT)很低：0.0-1.1；低（D错）：1.2-2.6；中（C错）：2.7-4.4；高（B错）：4.5-6.5；很高（A错）：6.6以上。